下列不属于心理治疗原则的是
A. 正义原则
B. 中立原则
C. 真诚原则
D. 保密原则
E. 回避原则

正确答案：A。正义原则

解析：根据第6版医学心理学，心理治疗的基本原则有信赖性原则（C对）、整体性原则、发展性原则、个性化原则、中立性原则（B对）、保密性原则（D对）。旧版心理学提及回避原则（E对），但是并无正义原则（A错，为本题正确答案）。